硝酸酯类、β受体阻断药和钙通道阻滞药治疗心绞痛均能
A. 减慢心率
B. 扩张冠状动脉
C. 缩小心室容积
D. 降低心肌耗氧量
E. 抑制心肌收缩力

正确答案：D。降低心肌耗氧量

解析：本题考查抗心绞痛药。硝酸酯类、β受体阻断剂、钙通道阻滞剂均为抗心绞痛药，能够增加心肌供血、供氧量，降低心肌耗氧量（D对）。硝酸酯类能够引起反射性心率加快（A错），不能缩小心室容积（C错）和抑制心肌收缩力（E错）。钙通道阻滞剂能降低心肌收缩力，但不能扩张冠状动脉（B错）。